属于非细胞型微生物的是
A. 柯萨奇病毒
B. 钩端螺旋体
C. 肺炎支原体
D. 白假丝酵母菌
E. 沙眼衣原体

正确答案：A。柯萨奇病毒

解析：病毒：病毒是一种体积微小，可以通过滤菌器，结构简单，只含有一种类型的核酸DNA或RNA。必须寄生在活的和敏感的细胞内，以复制的方式进行增殖的非细胞型微生物。掌握“病毒形态、结构、增殖及影响因素”知识点。